患者发热，热势或低或高，常在劳累后发作，乏力气短，自汗，食少便溏，舌质淡，苔薄白，脉细弱。治疗应首选
A. 清骨散
B. 归脾汤
C. 金匮肾气丸
D. 补中益气汤
E. 中和汤

正确答案：D。补中益气汤

解析：清骨散为内伤发热阴虚发热的选方，功能清虚热，退骨蒸（A错）。归脾汤为内伤发热血虚发热的选方，功能补气生血，健脾养心（B错）。金匮肾气丸为内伤发热阳虚发热的选方（C错）。题中患者以发热，热势或低或高为主症，无恶寒等外感症状，故诊断为内伤发热。发热，热势或低或高为中气不足，阴火内生，热郁于内而现于外所致，发热因气虚而致，劳则耗气，故常在劳累后发作，中气不足，脾失健运，故食少便溏，气虚不能生化水谷精微，脏腑经脉失于濡养，故乏力气短，气虚卫表不固，故自汗，舌质淡，苔薄白，脉细弱为气虚之象，故辨为气虚发热，治宜益气健脾，甘温除热，方选补中益气汤（D对）。中和汤常合黄连温胆汤治疗内伤发热痰湿郁热证，功能清热燥湿，理气化痰（E错）。